早产儿，孕龄32，自然分娩，出生后2小时出现呼吸困难，进行加重。查体：面紫，呻吟，三凹征阳性，支气管声低，未闻及啰音，腹软，肝下2cm。最可能的诊断是
A. 湿肺
B. 新生儿溶血
C. 吸入胎粪性肺炎
D. 新生儿呼吸窘迫综合征
E. 产程过长

正确答案：D。新生儿呼吸窘迫综合征

解析：32周早产儿（常见发病年龄），呼吸困难，三凹征，青紫，考虑诊断是新生儿呼吸窘迫综合征（D对）。该患儿无黄疸贫血等症状（B错）。胎粪吸入综合征（C错）多有宫内窘迫史和（或）出生窒息史，于生后即开始出现呼吸窘迫。新生儿湿肺（A错）又称新生儿暂时性呼吸增快，多见于足月儿或剖宫产儿，是由于肺内液体吸收及清除延迟所致，为自限性疾病，生后数小时内出现呼吸增快（＞60 ～8 0 次/分），但一般状态及反应较好，重者也可有青紫及呻吟等表现。产程过长是不是新生儿诊断（E错）。